下列哪项不是钙拮抗剂的适应症
A. 高血压
B. 心绞痛
C. 心律失常
D. 水钠潴留
E. 雷诺综合征

正确答案：D。水钠潴留

解析：钙通道阻滞药可扩张肾入球微动脉和出球微动脉，有效地降低肾血管阻力，增加肾血流量和肾小球滤过率，并抑制肾小管对水、钠的重吸收，有不同程度的排钠利尿作用，且无水钠潴留作用（D错，为本题正确答案）。钙通道阻滞药又称为钙拮抗药，可选择性阻滞电压依赖性钙通道，抑制细胞外钙离子内流，降低细胞内钙离子浓度，可用于高血压，其中硝苯地平、尼群地平等扩张外周血管作用强，用于治疗严重高血压患者，维拉帕米和地尔硫卓可用于轻中度高血压（A对）。钙通道阻滞药对于各型心绞痛（B对）都有不同程度的疗效，对变异型心绞痛硝苯地平疗效最佳，维拉帕米和地尔硫卓均可用于稳定型心绞痛。钙通道阻滞药通过减慢房室传导速度和延长不应期，取消折返，对室上性心动过速及后除极触发活动引起的心律失常效果良好（C对），其中维拉帕米和地尔硫卓减慢心率作用明显，可用于快速性心律失常，硝苯地平可反射性引起心率加快，一般不用于治疗心律失常。钙通道阻滞药如尼莫地平、硝苯地平等可扩张肢端小动脉，解除肢端小动脉收缩痉挛，因此可用于外周血管痉挛性疾病如雷诺病（E对）。